头面部痛温觉第一级神经元的胞体位于
A. 脊神经节
B. 三叉神经节
C. 三叉神经脊束核
D. 三叉神经脑桥核
E. 三叉神经中脑核

正确答案：B。三叉神经节

解析：参与头面部的痛温觉和触压觉传导通路的第一级神经元为三叉神经节（B对）内假单极神经元。第2级神经元的胞体在三叉神经脊束核（C错）和三叉神经脑桥核（D错）。参与躯干和四肢意识性本体感觉和精细触觉传导通路第一级神经元为脊神经节（A错）。